中风病的典型症状是
A. 半身不遂
B. 四肢抽搐
C. 但臂不遂
D. 肢体麻木
E. 昏不适人

正确答案：A。半身不遂

解析：中风病当以半身不遂为主症，若只有一侧手臂不能随意运动者，则为痹证。脉微为气血不足，是正虚的反映，数为病邪有余，是邪实之象，说明中风是因气血不足，外邪诱发为病。“脉微而数，中风使然”，阐释了“夫风之为病，当半身不遂”的机理（A对）。